女，63岁。发热伴腰痛3天。既往糖尿病病史8年。查体：T38.5℃，右肾区叩击痛（+）。血WBC11.3X10⁹/L，N0.88；尿常规：蛋白（+），糖（++），沉渣镜检RBC8～10/HP，WBC25～30/HP。对明确诊断最有意义的检查是
A. 肾穿刺活检
B. 尿找病理细胞
C. 清洁中段尿培养+药敏
D. 泌尿系B超
E. 尿相差显微镜检查

正确答案：C。清洁中段尿培养+药敏

解析：老年女性患者，有糖尿病病史（长期糖尿病病史是尿路感染的潜在危险因素），发热伴腰痛（发热、腰痛多提示上尿路感染，常见于肾盂肾炎），T38.5℃，右肾区叩击痛（+）（肾盂肾炎体温多高于38.0℃，且多有肾区叩击痛）。血WBC11.3×10⁹/L，N0.88（WBC正常值：4-10×10⁹/L，N正常值：0.5-0.7；该患者血WBC升高，中性粒细胞比例增高提示感染）；尿常规：蛋白（+），糖（++），尿沉渣镜检红细胞、白细胞阳性（提示患有泌尿系感染）。患者临床表现及相关辅助检查符合急性肾盂肾炎的临床诊断。采清洁中段尿做细菌培养+药敏（C对）既可初步确诊是何种细菌感染，又对及时选择有效抗生素有重要参考价值，是最有意义的检查（P494）。肾穿刺活检（A错）（八年制内科学第二版P584）可主要用于评估肾小球、肾小管、肾间质及血管病变的性质。尿找病理细胞（B错）（八年制外科学第二版P847）可用于泌尿系统肿瘤的诊断。泌尿系B超（D错）（八年制内科学第二版P584）主要用于泌尿系统结石和肾积水的诊断。尿相差显微镜检查（E错）（八年制内科学第二版P582）主要用于肾小球源性和非肾小球源性血尿的区分。